治疗脑膜炎球菌感染的药物是
A. 青霉素G
B. 羧苄青霉素
C. 两者均可
D. 两者均不可

正确答案：A。青霉素G

解析：本题考查治疗脑膜炎球菌感染的药物。青霉素G（A对）可治疗脑膜炎球菌感染。羧苄青霉素（BC错）为抗铜绿假单胞菌青霉素。羧苄西林为广谱青霉素的一种，它除对革兰阳性菌有杀菌作用外，还可穿透革兰阴性菌的脂多糖、磷脂外膜和脂蛋白，影响革兰阴性菌细胞壁黏肽的合成，因此对铜绿假单胞菌及变形杆菌感染有效。